糖尿病营养治疗的首要原则是
A. 合理控制能量
B. 限制脂肪摄入
C. 摄入足够的膳食纤维
D. 限制饮酒
E. 限制碳水化合物摄入

正确答案：A。合理控制能量

解析：本题考查糖尿病营养治疗的首要原则。糖尿病营养治疗的首要原则是合理控制总能量摄入（A对BCDE错）。《中国糖尿病医学营养治疗指南（2013）》建议糖尿病病人应接受个体化能量平衡计划，目标是既达到或维持理想体重，又满足不同情况下的营养需求。